按照无牙颌组织特点，颧突属于
A. 主承托区
B. 副承托区
C. 缓冲区
D. 后堤区
E. 边缘封闭区

正确答案：C。缓冲区

解析：本题考查无牙颌的功能分区。颧突是位于后弓区内相当于左右两侧上颌第一磨牙根部的骨突，有颊肌附着，表面覆盖的薄的黏膜，与之相应的基托边缘应做缓冲，属于缓冲区（C对）。而主承托区（A错）指垂直于（牙合）力受力方向的区域如牙槽嵴顶、腭侧穹窿区、颊棚区等。副承托区（B错）指与（牙合）力受力方向成角度的方向的区域如上下颌牙槽嵴顶的唇、颊和舌腭侧。后堤区（D错）指上颌义齿后缘的封闭区。边缘封闭区（E错）指义齿边缘接触的软组织部分如黏膜皱襞，系带附着部等。